某女，21岁。因湿浊中阻、脾胃不和导致胃脘疼痛、胸膈满闷、恶心呕吐，纳呆食少，经服香砂平胃丸收效，此中成药的功能有
A. 理气
B. 化湿
C. 和胃
D. 健脾
E. 止痛

正确答案：A、B、C、E。理气；化湿；和胃；止痛

解析：本题考查的是香砂平胃丸的功能。香砂平胃丸的功能有理气（A对）、化湿（B对）、和胃（C对）与止痛（E对）。香砂平胃丸：【功能】理气化湿，和胃止痛。附子理中丸：【功能】温中健脾（D错）。